重组IL-2被用来治疗
A. 转移性结直肠癌
B. 毛细胞白血病
C. 乳腺癌
D. B细胞淋巴瘤
E. 转移性黑色素瘤

正确答案：E。转移性黑色素瘤

解析：重组IL-2被用来治疗转移性黑色素瘤。掌握“肿瘤免疫”知识点。